肾功能不全者长期大量使用对乙酰氨基酚会出现
A. 镇痛药性肾病
B. 肾肿瘤
C. 嗜铬细胞瘤
D. 肾上腺素瘤
E. 肾结石

正确答案：A。镇痛药性肾病

解析：长期大量用药，尤其是在肾功能低下者，可出现肾绞痛或急性肾衰竭或慢性肾衰竭（镇痛药性肾病）。掌握“对乙酰氨基酚、布洛芬、塞来昔布”知识点。